为薄层致密骨，构成牙槽窝的内壁的骨板为
A. 皮质骨
B. 骨髓
C. 胶原纤维
D. 牙骨质
E. 硬骨板

正确答案：E。硬骨板

解析：固有牙槽骨为薄层致密骨，构成牙槽窝的内壁，它在X线片上呈围绕牙根的连续阻射白线，又称为硬骨板。掌握“根尖周病概述”知识点。